全身感染时，可导致低体温、低白细胞、低血压的致病菌是
A. 肺炎链球菌
B. 金黄色葡萄球菌
C. 变形杆菌
D. 溶血性链球菌
E. 破伤风梭菌

正确答案：C。变形杆菌

解析：革兰阴性杆菌引起感染时可导致三低现象即低温、低白细胞、低血压。常见的引起病变的革兰阴性杆菌包括大肠杆菌、绿脓杆菌、变形杆菌（C对）等。肺炎链球菌、金黄色葡萄球菌、溶血性链球菌和破伤风梭菌均为革兰阳性菌（ABDE错）。